引起庞蒂亚克热传染病的是
A. 布氏杆菌
B. 肺炎支原体
C. 嗜肺军团菌
D. 腮腺炎病毒
E. 登革病毒

正确答案：C。嗜肺军团菌

解析：本题考查引起庞蒂亚克热传染病的细菌。庞蒂亚克热传染病是军团病的一种临床表现类型，它是一种发病急且具自限性流感样疾病。军团病是由嗜肺军团菌（C对ABDE错）引起的一种以肺炎为主的全身性疾病，以肺部感染伴全身多系统损伤为主要表现，也可表现为无肺炎的急性自限性流感样疾病。